子宫肌壁问肌瘤主要表现为
A. 子宫增大，质软
B. 子宫增大，质硬
C. 子宫增大，伴有进行性加重痛经
D. 子宫增大，伴有突然下腹部疼痛
E. 以上均不是

正确答案：B。子宫增大，质硬

解析：子宫肌瘤的临床主要表现为1.症状：月经异常、下腹包块、压迫症状、白带增多、下腹坠胀，腰背酸痛，可伴不孕、继发性贫血等。浆膜下肌瘤蒂扭转时可出现急腹痛。肌瘤红色变性时，腹痛剧烈且伴发热。2.体征 子宫增大超过3个月妊娠大小或出现较大宫底部浆膜下肌瘤时，可在耻骨联合上方或下腹部正中扪及包块，实性，无压痛；若为多发性子宫肌瘤则肿块外形呈不规则状。妇科检查示子宫增大，表面可触及不规则单个或多个结节凸起，或触及单个球形肿块与子宫相连（浆膜下肌瘤），质硬；或宫颈口扩张，可见红色、实质、光滑包块位于宫颈管内，或脱出于宫口，位于阴道内（黏膜下肌瘤）；伴感染时可有坏死、出血及脓性分泌物覆着（B对）。